保和丸可用于下列除哪项以外的病证
A. 饮食伤胃型胃痛
B. 饮食内停型胃痞
C. 食滞痰阻型积聚
D. 食滞肠胃型泄泻
E. 食滞内停型呕吐

正确答案：C。食滞痰阻型积聚

解析：保和丸有消食导滞、理气和胃之功，凡食积内停证均可应用。积聚食滞痰阻证是由于食滞痰浊交阻，气聚成结，治宜导滞通便，理气化痰，代表方为六磨汤（C错，为本题正确答案）。胃痛之饮食伤胃证，机理为饮食积滞，阻塞胃气，治疗可用保和丸（A对）。胃痞之饮食内停证，机理为食滞内停，而致脾胃纳运失职，升降失司，发为胃痞，治疗可用保和丸（B对）。泄泻之食滞肠胃证，其机理为宿食内停，阻滞肠胃，传化失司，治疗可用保和丸（D对）。呕吐之食滞内停证，其机理为食积内停，气机受阻，浊气上逆，治疗可用保和丸（E对）。